影响酶活性的药物是
A. 麻黄碱
B. 维拉帕米
C. 氟尿嘧啶
D. 奥美拉唑
E. 去甲肾上腺素

正确答案：D。奥美拉唑

解析：本题考查奥美拉唑。影响酶活性的药物是奥美拉唑（D对）。奥美拉唑为第一代质子泵抑制剂（PPI），能够抑制H⁺-K⁺-ATP酶的活性，从而抑制胃酸生成；麻黄碱（A错）为非选择性的肾上腺素受体激动药；维拉帕米（B错）为钙通道阻滞剂；氟尿嘧啶（C错）是影响核酸代谢的抗肿瘤药物；去甲肾上腺素（E错）是强的α受体激动药。